颞下颌关节脱位病例中，以哪种类型最常见
A. 急性上脱位
B. 陈旧性脱位
C. 急性前脱位
D. 急性后脱位
E. 复发性后脱位

正确答案：C。急性前脱位

解析：本题考查颞下颌关节脱位。颞下颌关节脱位病例中，以急性前脱位（C对）最常见。在正常情况下，大开口末，髁突和关节盘易从关节窝向前滑动，止于关节结节之下方或前方（AD错），同时关节结节过高或关节结节前斜面过陡也可造成急性前脱位，故急性前脱位是颞下颌关节脱位中最常见的类型。复发性脱位（E错）多发生在颞下颌关节前脱位反复发作，未予以适当治疗，症状比较严重，在临床上比较少见。陈旧性脱位（B错）是指急性前脱位或复发性脱位在数周尚未复位者，关节局部组织受到撕拉、挤压，关节周围常有不同程度组织增生，在颞下颌关节脱位病例中不常见。